盐酸-镁粉反应是鉴定黄酮类化合物最常用的颜色反应。盐酸-镁粉反应呈阳性的黄酮类化合物类型有
A. 黄酮
B. 查尔酮
C. 黄酮醇
D. 橙酮
E. 二氢黄酮

正确答案：A、C、E。黄酮；黄酮醇；二氢黄酮

解析：本题考查黄酮类化合物的理化性质。能够发生盐酸-镁粉反应呈阳性的是黄酮（A对）、黄酮醇（C对）、二氢黄酮（E对）。黄酮类化合物显色反应：盐酸-镁粉（或锌粉）反应，是鉴别黄酮类化合物最常用的颜色反应。方法是将样品溶于1.0ml甲醇或乙醇中，加入少许镁粉（或锌粉）振摇，滴加几滴浓盐酸，1～2分钟内（必要时微热）即可显色。多数黄酮、黄酮醇、二氢黄酮及二氢黄酮醇类化合物显橙红色至紫红色，少数显紫色至蓝色，当B-环上有-OH或-OCH取代时，呈现的颜色亦即随之加深。但查耳酮（B错）、橙酮（D错）、儿茶素类则无该显色反应。异黄酮类化合物除少数例外，也不显色。